属于社会卫生状况评价的社会环境指标的是
A. 人均居住面积
B. 15岁以上人口识字率
C. 人均国内生产总值
D. 劳动人口就业率
E. 恩格尔系数

正确答案：A。人均居住面积